银汞合金在调制及使用过程中，不释放汞蒸气污染环境的是
A. 调制前汞散落
B. 调制过程未在密闭容器中进行
C. 排入下水道的散落的银汞合金碎屑
D. 硬固后的银汞合金碎屑
E. 放入15cm高饱和食盐水中的银汞合金碎屑

正确答案：E。放入15cm高饱和食盐水中的银汞合金碎屑

解析：本题考查汞的污染与防护。汞有很强的挥发性，在室温下即可挥发。从口腔内清除的银汞合金残渣应集中收集于装有放人15cm高饱和食盐水的容器中（E对），防止汞挥发污染环境，不应排入下水道（C错）。调制前汞散落（A错）会造成汞挥发。调制过程未在密闭容器中进行（B错），则挥发的汞会进入空气。硬固后的银汞合金碎屑（D错），若不密封保存，汞也会挥发污染空气。